男性，25岁，发现高血压2年，血压最高可达160/120mmHg，蛋白尿（﹢﹢），BUN28.6mmol/L，Scr442μmmol/L，应首先考虑为
A. 嗜铬细胞瘤
B. 肾性高血压
C. 高血压脑病
D. 高血压危象
E. 急性型高血压

正确答案：B。肾性高血压

解析：患者由于高血压引起蛋白尿阳性，BUN升高（正常范围3.2～7.1mmol/L），Scr升高（正常范围为30～110μmol/L），由于肾小球结构功能改变所致，故应首先考虑肾性高血压（B对）。嗜铬细胞瘤临床表现个体差异甚大，突然发生恶性高血压、心衰或脑出血等（A错）。高血压脑病动脉压升高取决于血压升高的程度及速度。多发生与急进型高血压和严重的缓进型高血压，后者一般情况严重，血压显著升高，血压达250/150mmHg左右才发生，而急性高血压患者血压未达到200/130mmHg亦能发生高血压脑病（C错）。高血压危象是指原发性或继发性高血压患者疾病发展过程中，在一些诱因的作用下血压突然和显著升高，病情急剧恶化，同时伴有进行性心、脑、肾、视网膜等重要的靶器官功能不全的表现（D错）。急性型高血压，此时收缩压大于等于180mmHg或舒张压大于等于120mmHg，可见到一个或多个靶器官直接损害的证据（E错）。